在IgA、IgM、IgG、IgE及IgD中IgE主要的抗体效应是
A. 中和作用
B. 调理作用
C. 裂解细胞作用
D. ADCC
E. 参与Ⅰ型超敏反应

正确答案：E。参与Ⅰ型超敏反应